胎盘未剥离时过早挤揉子宫可造成
A. 胎盘滞留
B. 胎盘粘连
C. 胎盘剥离不全
D. 胎盘嵌顿
E. 胎盘植入

正确答案：C。胎盘剥离不全

解析：第三产程中胎盘未剥离时过早挤揉子宫，影响胎盘正常剥离，从而造成胎盘剥离不全（C对）。胎儿娩出后子宫纤维缩复不良，易发生胎盘滞留（P211）（A错）或产后出血。胎盘绒毛黏附于子宫肌层表面时易造成胎盘粘连（P211）（B错）。胎盘嵌顿（P211）是子宫收缩药物应用（P211）不当，宫颈内口附近子宫肌出现环形收缩，使已剥离的胎盘嵌顿（D错）于宫腔。胎盘植入（E错）是指胎盘绒毛在其附着部位与子宫肌层紧密连接。